患儿，男，14岁。高热，头痛，呕吐。检查：脑膜刺激征（+），脑脊液压力高，含大量脓细胞，蛋白增高，涂片查到双球菌。应首先考虑的是
A. 流行性脑脊髓膜炎
B. 流行性乙型脑炎
C. 结核性脑膜炎
D. 脑肿瘤
E. 脊髓灰质炎

正确答案：A。流行性脑脊髓膜炎

解析：本例患者有高热，头痛，呕吐的临床表现，查体脑膜刺激征（+），提示脑膜病变时脊髓膜受到刺激并影响到脊神经根，脑脊液检查脑脊液压力高，含大量脓细胞，蛋白增高符合化脓性脑膜炎表现，涂片查到双球菌，应首先考虑的是流行性脑脊髓膜炎（A对）。流行性乙型脑炎（B错）外周血白细胞增高不显著，脑脊液呈无菌性脑膜炎改变，涂片及培养无细菌生长。结核性脑膜炎（C错）患者多有肺或其他部位的结核病灶，常缓慢起病、低热、头痛、呕吐等；脑脊液检查压力增高、外观透明或呈毛玻璃样混浊，静置后可形成薄膜，白细胞计数0.05～0.5×10⁹/L，淋巴细胞占多数，糖及氯化物减少，脑脊液涂片、培养检出结核杆菌可确诊。脑肿瘤（D错）脑脊液检查不会出现脓细胞。脊髓灰质炎（E错）瘫痪前期可出现高热、头痛、嗜睡、烦躁不安等中枢神经系统感染的症状，及颈强直、克氏征和布氏征阳性体征，此期脑脊液外观稍浑浊，压力增高，白细胞数增多，蛋白正常或略高，氯化物多正常，糖正常或偏高；自咽拭子及粪便可分离到病毒有助于确诊。